感染性心内膜炎合并心衰最常损伤的部位是
A. 室间隔内侧壁
B. 二尖瓣
C. 三尖瓣
D. 肺动脉瓣
E. 主动脉瓣

正确答案：E。主动脉瓣

解析：主动脉瓣（E对）是感染性心内膜炎合并心衰最常损伤的部位，其次为二尖瓣（B错）(50%) 和三尖瓣（C错）(19%)。亚急性者多发生于器质性心脏病，首先为心脏瓣膜病，尤其是二尖瓣和主动脉瓣；其次为先天性心血管病，如室间隔缺损、动脉导管未闭、法洛四联症和主动脉缩窄。赘生物常位于二尖瓣的瓣叶心房面、主动脉瓣的瓣叶心室面和室间隔缺损的右心室侧等，其血流从高压腔经病变瓣口或先天缺损至低压腔产生高速射流和湍流的下游，这些可能与处于湍流下方部位的内膜灌注压力下利于微生物沉积和生长有关。另外，高速射流冲击心脏或大血管内膜处（如二尖瓣反流面对的左心房壁、主动脉反流面对的二尖瓣前叶有关腱索和乳头肌，未闭动脉导管射流面对的肺动脉壁）等可致局部损伤，并易于感染，本病在压差小的部位，如房间隔缺损和大室间隔缺损或血流缓慢时，如房颤和心力衰竭时少见，瓣膜狭窄较关闭不全少见（A错）。